激活后能促进脂肪分解代谢的受体是
A. α₁受体
B. α₂受体
C. β₁受体
D. β₂受体
E. β₃受体

正确答案：E。β₃受体

解析：激活后能促进脂肪分解代谢的受体是β₃受体（E对），肾上腺素可与β₃受体结合继而激活甘油三酯酶，加速脂肪分解，使血液中游离脂肪酸浓度升高。肾上腺素也可与α1受体（A错）结合可扩瞳、脑血管收缩、胃肠括约肌收缩等，与α2受体（B错）结合可引起小肠平滑肌舒张、胃肠腺体分泌减少等，与心肌β₁受体（C错）结合可引起正性心力作用，与β₂受体（D错）结合，加强糖酵解。